药物的协同作用包括
A. 增敏作用
B. 脱敏作用
C. 增强作用
D. 相加作用
E. 拮抗作用

正确答案：A、C、D。增敏作用；增强作用；相加作用

解析：本题考查药物的协同作用。药物的协同作用包括相加作用（D对）、增强作用（C对）和增敏作用（A对）；脱敏作用（B错）指某药可使组织或受体对另一药物的敏感性减弱；拮抗作用（E错）是指两种或两种以上药物作用相反，或发生竞争性或生理性拮抗作用。